男，40岁。腹胀、乏力5个月。嗜睡言语混乱2天。既往患乙型肝炎20年。查体：：T：36.5℃，P：80次／分，R：18次／分，BP：120/80mmHg，神志不清，消瘦，皮肤巩膜黄染。双肺呼吸音清，未闻及干湿性啰音，心律齐，腹软，无压痛，移动性浊音（＋）。诱发患者出现神经精神症状的因素中，最不可能的是
A. 应用苯二氮䓬类镇静剂
B. 摄入大量蛋白质
C. 摄入大剂量维生素C
D. 应用大剂量利尿剂
E. 便秘

正确答案：C。摄入大剂量维生素C

解析：腹胀、乏力5个月。嗜睡言语混乱2天。既往患乙型肝炎20年。现患者神志不清，消瘦，皮肤巩膜黄染。考虑肝性脑病诊断。诱发肝性脑病，使患者出现精神因素的可能是：应用苯二氮䓬类镇静剂（A对）、摄入大量蛋白质（B对）使肠道氨的吸收增多、应用大剂量利尿剂（D对）可导致低钾性碱中毒，内环境紊乱、便秘（E对）可使肠道pH增高，增加氨的吸收。摄入大剂量维生素（C错，为本题正确答案）对诱发肝性脑病无影响。